粒径≤10μm的大气颗粒物称为
A. TSP
B. 气溶胶
C. 细颗粒物
D. IP
E. 降尘

正确答案：D。IP

解析：本题考查IP。粒径≤10μm的大气颗粒物称为IP（D对ABCE错），即可吸入颗粒物。